手足不温，腹痛，泄利下重，脉弦者，治宜选用
A. 健脾丸
B. 保和丸
C. 四逆散
D. 痛泻要方
E. 葛根黄芩黄连汤

正确答案：C。四逆散

解析：该题考查四逆散的主治病证。手足不温，腹痛，泄利下重，脉弦为阳郁厥逆证，是因外邪传经入里，气机郁遏，不得疏泄，导致阳气内郁，不能达于四末的假外寒证。健脾丸功能健脾和胃，消食止泻，主治脾虚食积证（A错）。保和丸功能消食和胃，主治食滞胃脘证（B错）。四逆散功能透邪解郁，疏肝理脾主治阳郁厥逆证和肝脾气郁证（C对）。痛泻要方功能补脾柔肝，祛湿止泻，主治脾虚肝旺之痛泻（D错）。葛根黄芩黄连汤功能解表清里，主治协热下利。（E错）。